下列不属于社会卫生状况评价的自然环境指标是
A. 人均居住面积
B. 安全饮用水普及率
C. 老龄化指数
D. 人均占有公共绿地面积
E. 成人识字率

正确答案：E。成人识字率